下列各项，宜采用透托法的是
A. 急性脓肿，毒盛正气不衰
B. 肿疡已成，正气已虚
C. 肿疡初起
D. 溃疡脓出不畅
E. 溃疡后期，疮口不敛

正确答案：D。溃疡脓出不畅

解析：透托法用于肿疡已成，毒盛正气不虚（A错），肿疡尚未溃破或溃破后脓出不畅（D对），多用于实证，方如透脓散。补托法用于正虚毒盛（B错），正气不能托毒外达，疮形平塌、根脚散漫不收、难溃难腐的虚证。消法是一切肿疡初起（C错）的治法总则。补法适用于溃疡后期，此期毒势已去，精神衰疲，血气虚弱，疮口难敛（E错）。